女，45岁，右乳头糜烂3个月。查体：右乳头皮肤表面结痂，去除痂皮可见鲜红色创面，触之易出血，协助确诊的首选检查是
A. 乳头刮片细胞学检查
B. 乳腺MRI
C. 乳腺钼靶
D. 乳腺超声
E. 乳腺空芯针穿刺活检

正确答案：A。乳头刮片细胞学检查

解析：中年女性患者，右乳头糜烂3个月，查体：右乳头皮肤表面结痂，去除痂皮可见鲜红色创面，触之易出血，根据患者的临床症状及体征，考虑最可能的诊断为乳腺癌，协助确诊的最佳检查是刮片（A对），其准确率较高。乳腺钼靶（C错）是常用的影像学检查方法，广泛用于乳腺癌的普查。乳腺超声（D错）属无损伤性，可反复使用，主要用途是鉴别肿块系囊性还是实质性。乳腺MRI（B错）是乳腺 X 线摄影和超声检查的重要补充。乳腺空芯针穿刺活检（E错）有创操作，少用。